肺脏严重淤血时不出现的改变是
A. 合并损伤
B. 透明膜形成
C. 肺泡出血
D. 肺泡水肿
E. 肺泡内含铁血黄素增加

正确答案：B。透明膜形成

解析：肺淤血包括急性肺淤血和慢性肺淤血，淤血可合并组织水肿、脏器实质器官萎缩等损伤（A对）。急性肺淤血镜下特点为部分肺泡充满伊红色水肿液，可见出血（C对），肺泡毛细血管扩张充血肺泡壁增厚，肺泡间隔水肿（D对）。慢性肺淤血时肺泡胞质内可形成含有含铁血黄素颗粒的心衰细胞（E对）。透明膜形成（B错，为本题正确答案）是呼吸窘迫综合征时，大量富含蛋白的液体渗出形成的，与肺淤血无关。